治小儿咳嗽时，不适于自行选择用药的疾病有
A. 肺炎
B. 急性喉炎
C. 感冒初起
D. 慢性咳嗽
E. 气管异物

正确答案：A、B、C、D、E。肺炎；急性喉炎；感冒初起；慢性咳嗽；气管异物

解析：本题考查的是自行选择用药。治小儿咳嗽时，不适于自行选择用药的疾病有肺炎（A对）、急性喉炎（B对）、感冒初起（C对）、慢性咳嗽（D对）、气管异物（E对）。治小儿咳嗽时，不适于自行选择用药的疾病有肺炎、急性喉炎、感冒初起、慢性咳嗽、气管异物。